脑血管畸形中最常见的类型是
A. 毛细血管扩张
B. 静脉畸形
C. 动静脉瘘
D. 海绵状血管畸形
E. 动静脉畸形

正确答案：E。动静脉畸形

解析：脑血管畸形是脑血管先天性、非肿瘤性发育异常，是指脑血管发育障碍而引起的脑局部血管数量和结构异常，并对正常脑血流产生影响，其破裂出血主要表现为脑内出血或血肿。一般分为动静脉畸形、毛细血管扩张、静脉畸形、海绵状血管畸形等四种类型，其中动静脉畸形（E对）占血管畸形的80%，为最常见类型，毛细血管扩张（A错）、静脉畸形（B错）、海绵状血管畸形（D错）三者总共不及20%。脑动静脉瘘（C错）即硬脑膜动静脉畸形，临床极少见。